LeFortⅢ型骨折是指
A. 锥形骨折
B. 下颌骨骨折
C. 上颌骨低位骨折
D. 上颌骨中位骨折
E. 上颌骨高位骨折

正确答案：E。上颌骨高位骨折

解析：本题考查骨折分型。LeFortⅢ型骨折是指上颌骨高位骨折（E对），骨折线自鼻额缝向两侧横过鼻梁、眶部，经颧额缝向后达翼突，形成颅面分离，常导致面中部拉长和凹陷，此型骨折多伴有颅底骨折或颅脑损伤，出现耳、鼻出血或脑脊液漏。上颌骨中位骨折（D错），又称锥形骨折（A错），是LeForⅡ型骨折，骨折线自鼻额缝向两侧横过鼻梁、眶内侧壁、眶底和颧上颌缝，再沿上颌骨侧壁至翼突，有时可波及筛窦达颅前窝，出现脑脊液鼻漏。上颌骨低位骨折（C错），又称水平骨折，是LeFortⅠ型骨折，骨折线从梨状孔水平、牙槽突上方向两侧水平延伸到上颌翼突缝。下颌骨骨折（B错）不属于LeFort骨折分类，临床表现为骨折段移位、咬合错乱、骨折段异常动度、下唇麻木、张口受限、牙龈撕裂。